下列检查项目中最急需的是
A. 神经系统检查
B. 脑CT
C. 脑脊液
D. EEG
E. ECG

正确答案：B。脑CT

解析：该患者青年女性，与邻居口角，被对方打了一耳光（外伤史），患者走回家中，取一菜刀追赶对方，被石头绊倒（外伤史），当即神志不清，牙关紧闭，双手握拳，四肢僵硬，呼之不应，半小时后遂来急诊，尚未清醒（疑似精神系统受损症状）。根据病史应考虑患者有外伤致急性脑出血的可能，因此最急需的为脑CT检查（B对）观察是否有脑出血。神经系统检查（A错）、脑脊液（C错）、EEG（脑电图）（D错）、ECG（E错）均不是最急需的。